患者，男，73岁，新诊断胃癌，腹腔已有淋巴结转移。在外科和肿瘤门诊就诊后，拟先行化疗治疗，该化疗称为
A. 研究性化疗
B. 新辅助化疗
C. 根治性化疗
D. 辅助化疗
E. 姑息性化疗

正确答案：B。新辅助化疗

解析：本题考查常见的化疗方式。新辅助化疗（B对）是指在局部治疗（手术或放疗）前采取的化疗，其目的主要在于使肿瘤体积缩小、改善血流，利于随后局部治疗的施行。